根据国务院发布的《公共场所卫生管理条例》规定，目前能依法进行卫生监督的公共场所共
A. 7类30种
B. 6类28种
C. 8类28种
D. 6类30种
E. 7类28种

正确答案：E。7类28种

解析：本题考查根据国务院发布的《公共场所卫生管理条例》规定，目前能依法进行卫生监督的公共场所种类。根据国务院发布的《公共场所卫生管理条例》规定，目前能依法进行卫生监督的公共场所共7类28种（E对ABCD错），包括：1.住宿与交际场所（8种）：宾馆、饭馆、旅馆、招待所、车马店、咖啡馆、酒吧、茶座；2.洗浴与美容场所(3种）：公共浴室、理发店、美容店；3.文化娱乐场所（5种）：影剧院、录像厅（室）、游艺厅（室）、舞厅、音乐厅；4.体育与游乐场所（3种）：体育场（馆）、游泳场（馆）、公园；5.文化交流场所(4种）：展览馆、博物馆、美术馆、图书馆；6.购物场所（2种）：商场（店）、书店；7.就诊与交通场所（3种）：候诊室、候车（机、船）室、公共交通工具（汽车、火车、飞机和轮船）。